卵子产生至受精过程
A. 卵巢仅产生卵子
B. 卵子溃破卵巢进入腹腔
C. 卵子经输卵管进入子宫
D. 在输卵管内受精
E. 受精卵植入子宫底的子宫内膜

正确答案：D。在输卵管内受精

解析：卵巢是产生卵子和分泌激素的器官（A错），卵巢破溃卵子可进入腹腔（B错），卵子一般在输卵管内受精（C错D对），受精卵通常植入子宫腔的子宫内膜（E错）。